以小动脉硬化为主的患者动脉血压变化特点是
A. 主要为收缩压升高
B. 收缩压与舒张压均升高
C. 主要为舒张压升高
D. 收缩压降低，舒张压升高
E. 收缩压升高，舒张压降低

正确答案：C。主要为舒张压升高

解析：体循环中血流阻力的大致分配为：主动脉及大动脉约占9%，小动脉及其分支约占16%，微动脉约占41%，毛细血管约占27%，静脉系统约占7%。可见产生阻力的主要部位是小血管（小动脉及微动脉）。小动脉硬化的患者，其外周阻力增大，心舒期内血液外流的速度减慢，因而舒张压明显升高（C对）。